评价人类的健康风险，最有说服力的证据是
A. 动物试验
B. 体外毒理学研究
C. 设计良好的流行病学研究
D. 化学物结构-活性关系资料
E. 毒物剂量-效应关系研究资料

正确答案：C。设计良好的流行病学研究

解析：本题考查评价人类的健康风险，最有说服力的证据。评价人类的健康风险，最有说服力的证据来自设计良好的流行病学研究（C对ABDE错），它能提供人类暴露与疾病之间的确切联系。